经营者以产品说明书表明商品质量状况的应
A. 保证其与提供的商品的实际质量状况相符
B. 向消费者出具服务单据
C. 按约定履行，不得无理拒绝
D. 作出明确的答复
E. 立即向有关行政部门报告和告知消费者

正确答案：A。保证其与提供的商品的实际质量状况相符

解析：本题考查消费者权益。经营者以产品说明书表明商品质量状况的应保证其与提供的商品的实际质量状况相符（A对）。经营者应当保证在正常使用商品或者接受服务的情况下其提供的商品或者服务应当具有的质量、性能、用途和有效期限；但消费者在购买该商品或者接受该服务前已经知道其存在瑕疵，且存在该瑕疵不违反法律强制性规定的除外。经营者以广告、产品说明、实物样品或者其他方式表明商品或者服务的质量状况的，应当保证其提供的商品或者服务的实际质量与表明的质量状况相符。